代谢性酸中毒的特征是
A. HCO₃⁻下降，pH下降，PaCO₂正常
B. HCO₃⁻上升，pH上升，PaCO₂正常
C. HCO₃⁻下降，pH上升，PaCO₂下降
D. HCO₃⁻正常，pH下降，PaCO₂下降
E. HCO₃⁻正常，pH下降，PaCO₂上升

正确答案：A。HCO₃⁻下降，pH下降，PaCO₂正常

解析：代谢性酸中毒的特征是HCO₃⁻下降，pH下降，PaCO₂正常。血气分析见血pH及HCO₃⁻、AB、SB下降，BE负值增加是代谢性酸中毒的典型表现（A对）。